位于垂体窝前方的结构是
A. 棘孔
B. 鞍背
C. 蝶鞍
D. 海绵窦
E. 交叉前沟

正确答案：E。交叉前沟

解析：垂体窝前方的结构是交叉前沟（E对）。鞍背是垂体窝后方的结构 (B错)。